男，43岁。右下肢疼痛，行走后加重3年。右小腿疼痛日益加重，时常出现沿表浅静脉走行的局部压痛、硬结。吸烟20余年。最有可能的诊断是
A. 动脉瘤
B. 血栓闭塞性脉管炎
C. 多发性动脉炎
D. 雷诺综合征
E. 动脉硬化性闭塞症

正确答案：B。血栓闭塞性脉管炎

解析：青年男性（血栓闭塞性脉管炎好发人群）患者，长期吸烟史（血栓闭塞性脉管炎发病的最主要原因之一）。右下肢疼痛，行走后加重（间歇性跛行，提示肢体远端缺血），时常出现沿表浅静脉走行的局部压痛，硬结（血栓性浅静脉炎的常见临床表现）。依据该患者的病史，最可能的诊断是血栓闭塞性脉管炎（B对）。动脉瘤（A错）最典型的表现为搏动性肿块及杂音，若瘤腔内附壁血栓或硬化斑块脱落，亦可出现远端肢体、器官缺血表现，但多为急性发作。多发性动脉炎（P491）（C错）多见于青年女性，常有低热、乏力、肌肉或关节疼痛、病变血管疼痛以及结节红斑等症状。雷诺综合征（P493）（D错）多见于青壮年女性，好发于手指，常为双侧性，典型症状为受累部位依次出现苍白、青紫和潮红。动脉硬化性闭塞征（P487）（E错）早期亦可表现为患肢冷感、苍白，进而出现间歇性跛行，但本病多见于中老年男性，患者多伴有高血压、冠心病、高脂血症、糖尿病等基础疾病，无血栓性浅静脉炎。